生活居住区的卫生要求不包括
A. 地势高，土壤清洁干燥
B. 良好日照，通风好
C. 附近有良好的水源
D. 有适宜的微小气候
E. 附近应有过境公路

正确答案：E。附近应有过境公路

解析：本题考查生活居住区的卫生要求。居住区是由城市主要道路或自然界线所围合，设有与其居住人口规模相应的、能满足居民物质与文化生活所需公共服务设施的相对独立的生活聚居地区。居住区环境质量的优劣直接影响到居民的健康，应选择地势高，土壤清洁干燥（A对），日照良好，通风好（B对），附近有良好的水源（C对），有适宜的微小气候（D对）的地段作为居住区用地。附近应有过境公路（E错，为本题正确答案）不属于生活居住区的卫生要求。